药品使用说明书中未收载的不良反应属于
A. A类药品不良反应
B. B类药品不良反应
C. 新的药品不良反应
D. 所有可疑不良反应
E. 药物相互作用引起的不良反应

正确答案：C。新的药品不良反应

解析：本题考查不良反应。药品使用说明书中未收载的不良反应属于新的药品不良反应（C对）。药品不良反应是指上市药品在正常用法用量下的与用药目的无关的或意外的有害反应。包括副作用、毒性作用、后遗效应、过敏反应、继发反应、特异性遗传素质等。目前WHO将药品不良反应分为A、B、C三种类型，各自特征如下：A类不良反应（A错）：可以预测；与常规的药理作用有关；反应的发生与剂量有关；发生率高，死亡率低；包括副作用、毒性作用、后遗效应、继发反应等。B类不良反应（B错）：难以预测，常规毒理学不能发现；与常规的药理作用无关；反应的发生与剂量无关；发生率低，死亡率高；可分为药物异常性和病人异常性。C类不良反应：背景发生率高；非特异性（指药物）；用药与反应发生没有明确的时间关系；潜伏期较长。